早期正确诊断传染病最重要的意义在于
A. 避免延误病情
B. 解决合理治疗
C. 有助于判断预后
D. 有助于流行病学调查
E. 有助于防止传播

正确答案：E。有助于防止传播